某女，25岁。月经量多，淋漓不断，色淡质稀，气短懒言，四肢不温，舌淡胖，苔薄白，脉缓弱。中医诊断为崩漏，证属脾不统血，治以固冲汤（白术、黄芪、煅龙骨、煅牡蛎、山茱萸、白芍、海螵蛸、茜草根、蒲黄、五倍子）。该处方中的白术，调配时应付
A. 炭制品
B. 麸炒品
C. 醋炙品
D. 盐炙品
E. 清炒品

正确答案：B。麸炒品

解析：本题考查的是常见的处方应付实例。该处方中的白术，调配时应付麸炒品（B对）。常见的处方应付实例：（1）处方直接写药名（或炒），需调配清炒品（D错），如紫苏子、莱菔子、谷芽、麦芽、王不留行、酸枣仁、蔓荆子、苍耳子、牛蒡子、白芥子等。（2）处方直接写药名（或炒），需调配麸炒品，如僵蚕、白术、枳壳等。（3）处方直接写药名（或制），需调配炮制品，如草乌（水制）、川乌（水制）、天南星（矾制）、附子（炮制）、吴茱萸（甘草水制）、远志（甘草水制去心）、厚朴（姜制）、何首乌等。（4）处方直接写药名（或炒或炙），需调配烫制品，如龟甲、鳖甲、穿山甲等。（5）处方直接写药名（或煅），需调配煅制品，如花蕊石、钟乳石、自然铜、金礞石、青礞石、瓦楞子等。（6）处方直接写药名（或炒或炭），需调配炭制品（A错），如干漆、炮姜、地榆、侧柏叶、蒲黄等。（7）处方直接写药名（或炒或炙），需调配蜜炙品，如枇杷叶、马兜铃等。（8）处方直接写药名（或炒或炙），需调配醋炙品（C错），如延胡索等。（9）处方直接写药名（或炒或炙），需调配盐炙品（E错），如补骨脂、益智仁等。